关于药物临床试验管理的说法，错误的是
A. 新药上市前须完成Ⅳ期临床试验，以充分考察评价该新药的收益与风险关系
B. 试验药物应在符合《药品生产质量管理规范》的车间制备
C. 应保证受试者在自愿参与前被告知足够的试验信息，理解并签署知情同意书
D. 临床试验应符合伦理道德标准，药物临床试验方案必须经过伦理委员会审查批准

正确答案：A。新药上市前须完成Ⅳ期临床试验，以充分考察评价该新药的收益与风险关系

解析：本题考查的是药物临床试验的内容和基本要求。新药在批准上市前，申请新药注册应当完成Ⅰ、Ⅱ、Ⅲ期临床试验（A错，为本题正确答案）。药物临床试验，分为Ⅰ期临床试验、Ⅱ期临床试验、Ⅲ期临床试验、Ⅳ期临床试验以及生物等效性试验。根据药物特点和研究目的，研究内容包括临床药理学研究、探索性临床试验、确证性临床试验和上市后研究新药在批准上市前，申请新药注册应当完成Ⅰ、Ⅱ、Ⅲ期临床试验。在某些特殊情况下，经批准也可仅进行Ⅱ期、Ⅲ期临床试验或仅进行Ⅲ期临床试验。药物临床试验用药品的管理应当符合药物临床试验质量管理规范的有关要求（B对）。临床试验应符合伦理道德标准，保证受试者在自愿参与前被告知足够的试验信息，理解并签署知情同意书（C对），保护受试者的安全、健康和权益。开展药物临床试验，应当符合伦理原则，制定临床试验方案，经伦理委员会审查同意（D对）。